关于急性化脓性腮腺炎病因的说法不包括
A. 主要致病菌是链球菌
B. 常见于腹部大手术后
C. 常见于高热或禁食的病员
D. 常见于体质虚弱、长期卧床的病员
E. 常见于急性传染病或脓毒血症的病员

正确答案：A。主要致病菌是链球菌

解析：急性化脓性腮腺炎的病原菌主要是金黄色葡萄球菌，链球菌及肺炎双球菌较少见。发生急性化脓性腮腺炎的基本因素是机体严重脱水致唾液分泌减少或停止。腮腺区的创伤和邻近组织急性炎症的扩展，也可继发腮腺的急性炎症。掌握“急性化脓性腮腺炎”知识点。